未经细菌侵入的创口属于
A. 无菌创口
B. 污染创口
C. 感染创口
D. 一期愈合创口
E. 延期愈合创口

正确答案：A。无菌创口

解析：本题考查口外创口处理。无菌创口（A对）系指未经细菌侵入的创口，多见于外科无菌切口，早期灼伤和某些化学性损伤已经及时处理者，也可以是无菌创口。